强心苷对哪种心衰的疗效最好
A. 肺源性心脏病引起
B. 严重二尖瓣狭窄引起的
C. 甲状腺功能亢进引起的
D. 严重贫血引起的
E. 高血压或瓣膜病引起的

正确答案：E。高血压或瓣膜病引起的